《疫苗管理法》所称的疫苗包括
A. 免费疫苗和自费疫苗
B. 儿童疫苗和成人疫苗
C. 进口疫苗和国产疫苗
D. 免疫规划疫苗和非免疫规划疫苗

正确答案：D。免疫规划疫苗和非免疫规划疫苗

解析：本题考查疫苗的分类。《疫苗管理法》规定，疫苗分为两类：免疫规划疫苗和非免疫规划疫苗（D对）。